妊娠期龈炎的临床变化与血中哪项激素水平相一致
A. 雄激素
B. 糖皮质激素
C. 孕酮
D. 甲状腺素
E. 甲状旁腺素

正确答案：C。孕酮

解析：本题考查妊娠期龈炎的病因。妊娠期龈炎指妇女在妊娠期间，由于女性激素水平升高，原有的牙龈慢性炎症加重，使牙龈肿胀或形成龈瘤样的改变。牙龈是女性激素的靶组织，妊娠时血液中的女性激素，特别是孕酮的水平升高，使得炎症细胞和液体渗出增加，加重了牙菌斑引起的炎症反应。妊娠期龈炎的临床变化与血中孕酮（C对）激素水平相一致。妊娠时，雄激素（A错）、糖皮质激素（B错）、甲状腺激素（D错）、甲状旁腺激素（E错）均略有增加，但增加量不明显，且与龈炎的临床变化无关。